K型根管器械的横截面是
A. 圆形
B. 三角形
C. 水滴形
D. 椭圆形
E. 不规则形

正确答案：B。三角形

解析：K型根管器械（1915年由Kerr公司制造而命名）：是使用最广泛的根管切削器械，是由截面为方形或三角形的不锈钢丝拧制而成。掌握“髓腔进入与初预备”知识点。